一小儿身高85cm，前囟已闭，头围48cm，乳牙20枚，已会跳并能用简单的语言表达自己的需要，对人事有喜乐之分。该小儿的年龄最大的可能是
A. 1岁
B. 1岁半
C. 2岁
D. 3岁
E. 3岁半

正确答案：C。2岁

解析：该小儿的年龄最大的可能是2岁的原因是：小儿身高85cm，前囟闭合，已会跳，有喜乐之分，都是2岁时的表现（C对）。